巨大卵巢囊肿与腹水鉴别最具有意义的体征是
A. 脐上移
B. 腹部明显膨隆
C. 腹部叩诊浊音
D. 腹部两侧叩诊呈鼓音
E. 尺压试验时，直尺随腹主动脉搏动

正确答案：E。尺压试验时，直尺随腹主动脉搏动

解析：巨大卵巢囊肿平卧时腹部中间隆起，叩诊浊音，腹部两侧鼓音（D对），无移动性浊音，边界清楚。腹水平卧叩诊时，腹部中间鼓音，两侧浊音，移动性浊音阳性。因腹主动脉的搏动可经囊肿传到硬尺，故巨大的卵巢囊肿尺压试验阳性，而腹水为阴性（E对）。本题DE均对，给出的答案为E。